某女患头痛数月，遇上感冒和月经来潮时疼痛加重，于是出于彻底检查的目的来院坚决要求作CT检查，被医师拒绝。医师开出脑电图检查单和请耳鼻喉科会诊单。病人大为不满。为形成正常医患关系，该医师应该
A. 维持契约关系，完全按病人要求办，开单作CT检查
B. 维持契约关系，坚决按医生意见办，脑电图检查后再定
C. 维持契约信托关系，说服患者先行体格检查再定
D. 维持信托关系，对不信赖者拒绝接诊
E. 维持信托关系，先查Cr和脑电图、进行会诊，然后体检

正确答案：C。维持契约信托关系，说服患者先行体格检查再定

解析：医患信托关系是医务人员和医疗机构受患者的信任和委托，保障患者在医疗活动中的健康利益不受损害并有所促进的一种关系。患者的求医行为隐含着对医方的希望和信任，而医方的特殊职业性质和职业信誉，要求其必须接受患者的托付，并以救死扶伤的人道主义精神尽可能地实现患方的希望和托付，这也是医方的义务和责任。掌握“医患关系伦理”知识点。